小白鼠虽获得的数据有限，与人类有区别，但仍不可替代的原因是
A. 尽量用低等动物
B. 能获得更多实验数据
C. 能获得更接近人类的数据
D. 价格便宜
E. 繁殖快

正确答案：A。尽量用低等动物

解析：在国际伦理规范中，传统的保护实验动物的“3R”伦理原则是1959年英国学者在《人道实验技术的原则》一书中提出的有关动物实验的原则，我国《关于善待实验动物的指导性意见》认可并解释了“3R”原则,即替代（replacement）、减少（reduction）、优化（refinement），其中替代是指使用没有知觉的实验材料代替活体动物，或使用低等动物替代高等动物进行试验，故答案选择尽量用低等动物（A对）。